下列各类疾病中，主要应采取第一级预防的是
A. 职业病
B. 冠心病
C. 糖尿病
D. 高血压
E. 病因不明，难以觉察预料的疾病

正确答案：A。职业病

解析：职业因素所致疾病的病因明确而且是人为的，主要应采取第一级预防（A对）。心、脑血管疾病（BD错）、代谢性疾病（C错）的病因是多因素的，要按其特点，进行筛检、及早诊断和治疗，除针对其危险因素，致力于第一级预防外，还应兼顾第二和第三级预防。第二级预防是在疾病的临床前期通过采取早期发现、早期诊断、早期治疗的“三早”预防措施，以控制疾病的发展和恶化。第三级预防是对已患某些病者，采取及时的、有效的治疗措施，终止疾病的发展、防止病情恶化、预防并发症和伤残。病因和危险因素都不明，又难以觉察预料的疾病，只有施行第三级预防这一途径（E错）。